下列是半可调（牙合）架制作全口义齿的优点，除了
A. 可以根据实际情况调节前伸髁导斜度
B. 可以根据实际情况或根据平均值调节侧方髁导斜度
C. 可以转移上颌对颞下颌关节的位置关系
D. 能很大程度模拟下颌前伸及侧方运动
E. 可以将患者所有有关参数转移到（牙合）架

正确答案：E。可以将患者所有有关参数转移到（牙合）架

解析：本题考查半可调（牙合）架制作全口义齿的优点。半可调（牙合）架制作全口义齿的优点，除了可以将患者所有有关参数转移到（牙合）架（E错，为本题的正确答案）。半可调（牙合）架以根据每位患者的实际情况调节前伸髁导斜度（A对）和侧方髁导斜度（B对）。上颌对颞下颌关节的位置关系就是下颌骨的相对位置关系（C对）。半可调（牙合）架的髁导和切导斜度均可调节，能很大程度模拟下颌前伸及侧方运动（D对），但是任何一种（牙合）架都不可能将患者所有有关参数转移到（牙合）架。